男性，31岁。1年来疑被人迫害、数次出走后被家人找回。近半年来常行为诡秘，将家中闹钟、收音机等在半夜深埋在公园树林地下，对亲友冷淡，生活懒散，房间内藏有刀棍等，体格检查无阳性发现。精神状况检查：接触被动，有自语自笑，衣着尚得体。其称“有人要谋害我”“有人命令我要么自杀、要么逃出去。”否认有病，无知力。如考虑为精神分裂症，其妄想的特点是
A. 属原发性妄想
B. 属继发性妄想
C. 属释疑性妄想
D. 属特殊意义妄想
E. 属虚无妄想

正确答案：A。属原发性妄想